关于完整的乳牙列的重要作用，下列说法正确的是
A. 有利于儿童的消化吸收
B. 有利于儿童的心理发育
C. 有利于儿童的正常生长
D. 有利于儿童的正确发音
E. 以上都是

正确答案：E。以上都是

解析：本题考查完整的乳牙列的作用。完整的乳牙列对儿童的消化吸收（A对）、心理发育（B对）、生长发育（C对）和发音（D对）都有着重要影响。因此应保护乳牙列，重视儿童的口腔预防保健工作，对龋坏牙齿应该及时治疗，不应轻易拔除。